严重（牙合）面磨损引起颞下颌关节紊乱病的主要原因是
A. 颌间垂直距离过短，引起关节损伤
B. 边缘嵴和发育沟缺损，导致牙合面外形不完整
C. 不均匀磨损遗留高陡牙尖，造成咬合创伤
D. 牙本质过敏，造成牙合力不足，损害关节
E. 长期的咀嚼使牙合力应力集中，损害关节

正确答案：A。颌间垂直距离过短，引起关节损伤

解析：本题考查严重（牙合）面磨损引起颞下颌关节紊乱病的主要原因。严重的（牙合）面磨损导致牙冠明显变短，在牙尖交错位时下颌位置较正常时上移，使颌间距离变短，髁突在颞下颌关节窝中的位置向后上移位，出现关节后压迫，引起关节损伤（A对）。边缘嵴和发育沟缺损，导致（牙合）面外形不完整主要使食物溢出作用减弱，导致食物嵌塞（B错）。不均匀磨损遗留高陡牙尖，造成咬合创伤，可诱发颞下颌关节紊乱病，但不是磨损引起颞下颌关节紊乱病的主要原因（C错）。严重（牙合）面磨损导致牙本质暴露，使牙本质敏感，其主要危害在于刺激牙髓，引起牙髓病和根尖周病（D错）。长期的咀嚼使（牙合）力应力集中，主要对牙体牙周支持组织造成损害（E错）。